治疗再生障碍性贫血热入营血证，应首选
A. 圣愈汤
B. 犀角地黄汤
C. 左归丸
D. 龙胆泻肝汤
E. 苇茎汤

正确答案：B。犀角地黄汤

解析：犀角地黄汤可以清心凉营，故用于治疗再生障碍性贫血热入营血证（B对）。圣愈汤（A错）用于恶疮出血过多，气血两虚。归丸（C错）用于真阴不足之证。龙胆泻肝汤（D错）用于肝胆实火上扰。苇茎汤（E错）用于肺痈，热毒壅滞，痰瘀互结证。